肝门静脉不收集下列哪种脏器的静脉血
A. 肝
B. 直肠上部
C. 胰
D. 胆囊
E. 胃

正确答案：A。肝

解析：肝（A错，为本题正确答案）的静脉血由肝静脉收集。直肠上部（B对）、胰（C对）、胆囊（D对）、胃（E对）的静脉血均为肝门静脉所收集。